甲状腺功能亢进的最常见病因是
A. 弥漫性毒性甲状腺肿
B. 多结节性甲状腺肿
C. 甲状腺自主高功能腺瘤
D. 亚急性甲状腺炎
E. 桥本氏病

正确答案：A。弥漫性毒性甲状腺肿

解析：甲状腺功能亢进患者中80%是由Graves病即弥漫性毒性甲状腺肿引起的（A对）。多结节性甲状腺肿（B错）、甲状腺自主高功能腺瘤（C错）虽可引起甲状腺功能亢进，但较少见。亚急性甲状腺炎（D错）可出现血清甲状腺激素增多导致甲状腺毒症，但其发生机制为甲状腺被破坏后大量甲状腺激素一过性释放入血引起，其甲状腺本身功能并未亢进，反而减弱。桥本氏病（E错）为自身免疫性疾病，病因不明，初期因自身甲状腺组织遭受破坏而大量释放甲状腺激素入血而造成甲状腺毒症，但后期会因为可合成甲状腺激素的甲状腺组织过少而表现为甲状腺功能低下。